某县药品监督管理部门接到某药店将保健食品作为药品出售给患者的举报后，立即对该药店进行了查处，并依照《药品管理法》的规定，将其销售给患者的保健食品认定为
A. 按假药论处的药
B. 假药
C. 食品
D. 劣药
E. 按劣药论处的药

正确答案：B。假药

解析：保健食品不是药品，根据《药品管理法》规定，将非药品作为药品销售的属于假药（B对）。劣药，是指药品成分含量不符合国家药品标准规定的药品。因为保健食品不是药品，所以不能认定为劣药（D错），也不属于按假药论处的药（A错）或者按劣药论处的药（E错）。